在粉末中含草酸钙簇晶的薄壁细胞常纵列成行的药材是
A. 大黄
B. 白芍
C. 人参
D. 何首乌
E. 三七

正确答案：B。白芍

解析：本题考查的是白芍的显微鉴别。在粉末中含草酸钙簇晶的薄壁细胞常纵列成行的药材是白芍（B对）。白芍【显微鉴别】粉末白芍、炒白芍、酒白芍：糊化淀粉粒团块甚多。草酸钙簇晶直径11～35㎛，存在于薄壁细胞中，常排列成行或一个细胞中含数个簇晶。纤维长梭形，直径15～40㎛，壁厚，微木化，具大的圆形纹孔。大黄（A错）【显微鉴别】粉末大黄、酒大黄、熟大黄、大黄炭：草酸钙簇晶大而多，直径20～160㎛，有的至190㎛。大黄粉末微量升华，可见菱状针晶或羽状结晶。人参（C错）【显微鉴别】粉末人参、人参片：树脂道碎片易见，含黄色块状分泌物。草酸钙簇晶棱角锐尖，直径为20～68㎛。木栓细胞表面观为类方形或多角形，壁细波状弯曲。何首乌（D错）【显微鉴别】粉末：黄棕色。草酸钙簇晶较多，直径10～80㎛，偶见簇晶与较大的方晶合生。导管主为具缘纹孔导管，直径17～178㎛。③淀粉粒单粒类圆形，直径4～50㎛，脐点人字形、星状或三叉状，大粒者隐约可见层纹；复粒由2～9分粒组成。棕色细胞类圆形或椭圆形，壁稍厚，胞腔内充满黄棕色、棕色或红棕色物质，并含淀粉粒。棕色块随处散在，形状、大小及颜色深浅不一。木纤维少见，壁薄，纹孔明显。三七（E错）【显微鉴别】粉末：灰黄色。树脂道碎片内含黄色分泌物。草酸钙簇晶稀少，直径50～80㎛，其棱角较钝。导管有网纹、梯纹及螺纹导管，直径15～55㎛。淀粉粒众多，单粒呈类圆形、半圆形或圆多角形，直径4～30㎛，脐点点状或裂缝状；复粒由2～10分粒组成。木栓细胞呈长方形或多角形，壁薄，棕色。